诱导肝微粒体酶，加速皮质激素和雌激素代谢
A. 乙胺丁醇
B. 利福平
C. 异烟肼
D. 对氨基水杨酸
E. 卡那霉素

正确答案：B。利福平